对急性中毒出现循环衰竭者需
A. 及时供氧
B. 洗胃、灌肠
C. 服用鸡蛋清
D. 饮服甘草、绿豆汤
E. 停用一切药物，同时禁食

正确答案：A。及时供氧